感染性休克的常见病原体为
A. 革兰氏阴性细菌
B. 革兰氏阳性细菌
C. 病毒
D. 支原体
E. 钩端螺旋体

正确答案：A。革兰氏阴性细菌

解析：感染性休克（P38）分为冷休克和暖休克，冷休克多由革兰阴性菌（A对）引起，较多见；暖休克多由革兰氏阳性细菌（B错）引起，较少见。病毒（C错）、支原体（D错）、钩端螺旋体（E错）几乎不引起感染性休克。